链霉素和红霉素等抗生素可与哪项结合，起到抗菌作用
A. 核质
B. 中介体
C. 肽聚糖
D. 核糖体
E. 异染颗粒

正确答案：D。核糖体

解析：核糖体：每个细菌可含有万余个核糖体，它由占66%的RNA及占34%的蛋白质构成，是细菌蛋白质合成的场所。掌握“细菌的大小、形态和基本结构”知识点。